评价体力劳动强度大小的主要依据是
A. 心排出量
B. 排汗量
C. 能量消耗量
D. 心率
E. 直肠温度

正确答案：C。能量消耗量